在下列与细胞凋亡有关的基因中，最易受砷的影响，从而表达异常的是
A. c-myc
B. p53
C. bcl-2
D. bcl-x
E. bcl-1

正确答案：C。bcl-2

解析：本题考查砷影响细胞凋亡调控基因的表达。砷对调控细胞凋亡的许多基因都能发生作用，例如p53、c-myc、bcl-2、bcl-x、bax及bad等，其中砷对bcl-2（C对ABDE错）基因表达的影响在细胞凋亡中尤显重要。研究表明，三氧化二砷可使NB₄细胞 bcl-2表达下降，而对bax、p53、c-myc基因表达无影响。